职业病防治工作应坚持以下方针
A. 预防为主、防治结合
B. 分类管理、综合治理
C. 预防为主、综合治理
D. 防治结合、综合治理
E. 预防为主、分类管理

正确答案：A。预防为主、防治结合